男性，9岁。左上颌后牙有洞2个月求补。口腔检查：左上Ⅴ残冠，左上Ⅴ已无法修复。6已萌出。拔除后应上哪种间隙保持器
A. 远中导板保持器
B. 丝圈保持器
C. 功能性活动保持器
D. 舌弓保持器
E. 间隙扩展装置

正确答案：B。丝圈保持器

解析：本题考查丝圈保持器的适应证。丝圈保持器（B对）是在选择的基牙上装配带环（全冠），在缺牙处通过弯制的金属丝来维持缺隙的近远中距离，适用于单侧第一磨牙早失或第一恒磨牙萌出后，第二乳磨牙单侧早期丧失的病例，亦或是双侧乳磨牙早失，用其他间隙保持器装置困难的病例。远中导板保持器（A错）适用于第二乳磨牙早失、第一恒磨牙尚未萌出或萌出中。功能性活动保持器（C错）适用于乳磨牙缺失两个以上者，或两侧磨牙缺失，或伴有前牙缺失，它不仅能保持缺牙的近远中长度，还能保持垂直高度和恢复咀嚼功能，恢复因缺牙造成的语音功能障碍，改进和克服口腔不良习惯。舌弓保持器（D错）是将舌弓的两端固定在第二乳磨牙或第一恒磨牙上，以保持牙弓周长和牙齿间隙的保持器，是一种用于下颌的保持器。间隙扩展装置（E错）又叫间隙恢复装置，适用于缺牙间隙的近远中邻牙均向缺牙间隙移动的病例。